治疗慢性再生障碍性贫血的常用药物是
A. 铁剂
B. 甲泼尼松
C. 雄激素
D. 一叶萩碱
E. 环孢素

正确答案：C。雄激素

解析：治疗慢性再生障碍性贫血的常用药物是雄激素（C对），雄激素可刺激骨髓造血，可缓解骨髓造血功能衰竭。铁剂（A错）用于缺铁性贫血的治疗。甲泼尼松（B错）属于激素类药物，常用于抗炎以及自身免疫病的治疗，如系统性红斑狼疮、风湿性疾病等。—叶萩碱（D错）为中枢神经兴奋药物，可用于面神经麻痹、小儿麻痹后遗症、神经衰弱、嗜睡症等的治疗。环孢素（E错）可用于重型再生障碍性贫血及难治性自身免疫性血小板减少性紫癜等的治疗。